结构中通常含有α-去氧糖的苷类化合物是
A. 环烯醚萜苷
B. 蒽醌苷
C. 二萜苷
D. 黄酮苷
E. 强心苷

正确答案：E。强心苷

解析：本题考查的是强心苷的结构特征。结构中通常含有α-去氧糖的苷类化合物是强心苷（E对）。α-去氧糖常见于强心苷类，是区别于其他苷类成分的一个重要特征。强心苷中普遍具有α-去氧糖，如D-洋地黄毒糖等2，6-二去氧糖；L-夹竹桃糖、D-加拿大麻糖、D-迪吉糖和D-沙门糖等2，6-二去氧糖甲醚。含环烯醚萜苷（A错）类化合物有中药有栀子、鸡屎藤、地黄等。蒽醌苷（B错）：属于结合型蒽醌，为大黄的主要成分之一。二萜苷（C错）：二萜多以树脂、内酯或苷的形式广泛存在于自然界。黄酮苷（D错）：天然黄酮类化合物多以苷类形式存在，并且由于糖的种类、数量、连接位置及连接方式的不同，可以组成各种各样的黄酮苷类。